为防止游离酸对牙髓的刺激，年轻患者的恒牙（活髓牙）采用铸造全冠修复时，不能用的黏固剂是
A. 磷酸锌黏固剂
B. 玻璃离子黏固剂
C. 丁香油黏固剂
D. 羧酸玻璃离子黏固剂
E. 聚羧酸锌黏固剂

正确答案：A。磷酸锌黏固剂

解析：磷酸锌粘固剂：具有较高的抗压强度，粘固力强。粘固时pH为3.5，由于这一酸性状态，对牙髓有刺激作用，活髓牙不宜使用。掌握“修复体试戴、磨光与粘固”知识点。